关于加巴喷丁的说法错误的是
A. 加巴喷丁是GABA的环状衍生物，具有较高脂溶性
B. 加巴喷丁口服易吸收，在体内不代谢，以原型从尿中排除
C. 加巴喷丁对神经性疼痛有效
D. 加巴喷丁通过作用GABA受体而发挥作用
E. 加巴喷丁可与其他抗癫痫药物联合使用

正确答案：D。加巴喷丁通过作用GABA受体而发挥作用

解析：本题考查加巴喷丁。加巴喷丁是GABA的环状衍生物，具有较高脂溶性，但并非GABA受体的激动剂（D错，为本题正确答案），与脑组织神经元上所结合的受体尚未确定，其作用机制尚未弄清。